属于肾髓质的是
A. 肾盂
B. 肾静脉
C. 肾动脉
D. 肾乳头
E. 肾柱

正确答案：D。肾乳头

解析：肾静脉（B错）、肾动脉（C错）和肾盂（A错）位于肾蒂内，肾乳头为肾髓质成分（D对），肾柱为伸入肾锥体之间的肾皮质（E错）。